治疗休息痢，应首选
A. 连理汤
B. 半夏泻心汤
C. 乌梅丸
D. 左金丸
E. 温脾汤

正确答案：A。连理汤

解析：痢疾休息痢是由于病久正伤，而导致邪恋肠腑，传导不利。治疗应该温中调气，清肠化滞。温中补脾兼清湿热的连理汤最为合适（A对）。半夏泻心汤功能辛开苦降，寒热并调，为治疗胃痛寒邪客胃证的选方（B错）。乌梅丸功能温脏安蛔，为治疗胁痛肝胆湿热证胁肋剧痛，呕吐蛔虫者，可先以乌梅丸安蛔，再予驱蛔（C错）。左金丸功能清泻肝火，降逆止呕，为治疗呕吐之肝气犯胃证的选方（D错）。温脾汤功能攻下冷积，温补脾阳，可治疗痢疾休息痢见脾阳虚极，肠中寒积不化，遇寒即发，症见下痢白冻，倦怠少食，舌淡苔白，脉沉者（E错）。